女，36岁，妊娠8周，心悸气短2天，3年前确诊为，风湿性心脏病，二尖瓣狭窄，2年前因心力衰竭住院治疗。对该孕妇的处理为
A. 应用洋地黄
B. 二尖瓣扩张术
C. 负压吸引引流术
D. 继续妊娠
E. 药物流产

正确答案：C。负压吸引引流术

解析：中年女性孕妇，36岁（年龄在35岁以上），3年前确诊为风湿性心脏病二尖瓣狭窄，2年前因心力衰竭住院治疗（既往有心脏病史，且病变复杂，病程较长），现妊娠8周，心悸、气短2天，属于不宜妊娠范围（ABD错）。因目前妊娠8周（大于药流49日小于10周，负压吸宫术适用于妊娠10周以内的孕妇），应进行负压吸引引流术（C对E错）。